男，70岁。因腹主动脉瘤在某市级医院接受手术治疗，术中发生大出血，经抢救无效死亡。其子女要求复印患者在该医院的全部病历资料，而院方只同意复印其中一部分。根据《医疗事故处理条例》规定，其子女有权复印的病历资料是
A. 疑难病例讨论记录
B. 上级医师查房记录
C. 死亡病例讨论记录
D. 会诊意见
E. 手术及麻醉记录单

正确答案：E。手术及麻醉记录单

解析：根据《医疗事故处理条例》规定，患者有权查阅、复印或者复制自己的客观性病历资料，包括门诊病历、住院志、体温单、医嘱单、化验单（检验报告）、医学影像检查资料、特殊检查同意书、手术同意书、手术及麻醉记录单、病理资料、护理记录以及国务院卫生行政部门规定的其他病历资料。患者子女有权复印的病历资料是其父亲的客观性病历资料，包括手术及麻醉记录单（E对）。病例讨论记录（C错）、疑难病例讨论记录（A错）、上级医师查房记录（B错）、会诊意见（D错）属于主观性病历资料（P330）。